青霉素抗革兰阳性（G+）菌作用的机制是
A. 干扰细菌蛋白质合成
B. 抑制细菌核酸代谢
C. 抑制细菌脂代谢
D. 抑制细菌细胞壁肽聚糖（粘肽）的合成
E. 破坏细菌细胞膜结构

正确答案：D。抑制细菌细胞壁肽聚糖（粘肽）的合成

解析：青霉素属于β-内酰胺类抗生素，可以和转肽酶共价结合，导致细菌细胞壁黏肽的合成受阻（D对），细胞壁缺损，水分由外环境不断渗入高渗的菌体内，致细菌膨胀，变形死亡；同时β-内酰胺类抗生素可增加细菌壁的自溶酶的活性，使细菌自溶或细胞壁水解。干扰细菌蛋白质的合成（A错）（P376）为大环内酯类抗生素的抗菌作用机制。抑制细菌核酸代谢（B错）（P196）为喹诺酮类抗生素抗菌的作用机制。目前还有没抗生素的作用机制是针对抑制细菌脂代谢（C错）、破坏细菌细胞膜的结构（E错）。